肝硬化患者血氨增高的诱因可以是
A. 胃肠运动增强
B. 胃肠道出血
C. 脂肪酸摄入减少
D. 糖类摄入减少.
E. 肠道内细菌活动减弱

正确答案：B。胃肠道出血

解析：肝硬化患者常见的上消化道出血（B对）、过量蛋白饮食、输血等外源性氮负荷过度，可通过促进血氨增高而诱发肝性脑病。